泄泻发病的重要因素是
A. 肝脾不和
B. 脾胃虚弱
C. 脾虚湿盛
D. 脾肾两虚
E. 脾失运化

正确答案：C。脾虚湿盛

解析：泄泻的病变主脏在脾，主要病机为脾虚湿盛，湿为阴邪，易困脾阳，但亦可夹寒、夹热、夹滞，使脾运失职，小肠无以分清泌浊，故发生泄泻，常有无湿不成泻之说（C对）。肝脾不和是肝失疏泄，脾失健运，两脏关系失调，功能紊乱所致的病症。又称肝脾不调。临床以胁腹胀痛为主要表现（A错）。脾胃虚弱由脾虚导致湿困，最终脾虚湿盛致泻（B错）。脾肾两虚是痴呆的病机，与泄泻无关（D错）。脾失运化对泄泻的发生因素概括不全（E错）。